女，28岁。反复牙龈出血和月经增多半年。查体：轻度贫血貌，巩膜无黄染，肝脾肋下未触及。实验室检查：Hb82g/L，RBC4.0×10¹²/L，WBC5.6×10⁹/L，Plt13×10⁹/L，骨髓增生明显活跃，红系占36%，巨核细胞明显增多，产板型巨核细胞少，骨髓内外铁均减少。该患者最可能的诊断是
A. 溶血性贫血
B. 慢性ITP合并缺铁性贫血
C. 慢性再生障碍性贫血
D. 急性白血病
E. 骨髓增生异常综合征

正确答案：B。慢性ITP合并缺铁性贫血

解析：患者青年女性，反复牙龈出血和月经增多半年（ITP患者血小板减少，有出血倾向，表现为皮肤、黏膜出血，鼻出血、牙龈出血常见，内脏出血少见但月经过多常见），查体：轻度贫血貌，巩膜无黄染，肝脾肋下未触及（ITP患者一般无肝脾肿大），实验室检查：Hb82g/L（成年女性Hb正常值110～150g/L）提示贫血，RBC4.0×10¹²/L（女性正常3.5～5.0×10¹²/L），WBC5.6×10⁹/L（正常4～10×10⁹/L），Plt13×10⁹/L（正常100～300×10⁹/L）明显减少，骨髓巨核细胞明显增多，产板型巨核细胞少（ITP骨髓巨核细胞成熟障碍巨核细胞正常或增多，产板型巨核细胞减少），故患者应诊断为慢性特发性血小板减少性紫癜（ITP），患者有长期失血史，失血伴随失铁，且骨髓增生明显活跃，红系占36%，提示骨髓增生以红系为主（符合缺铁性贫血的变化），骨髓内、外铁均减少（有贮存铁减少的实验室证据），综合分析患者最可能的诊断是慢性ITP合并缺铁性贫血（B对）。溶血性贫血（P552）（A错）常有贫血、黄疸、脾大等表现，无贮存铁减少；慢性再生障碍性贫血（P547-P548）（C错）可有贫血、出血等表现，肝脾一般不大，但骨髓增生减低或重度减低，粒、红系及巨核细胞明显减少；急性白血病（P571）（D错）常有贫血、出血、感染等症状，可有肝脾肿大，骨髓原始及幼稚细胞增多；骨髓增生异常综合征（P564）（E错）常有贫血、出血、感染等症状，骨髓有病态造血表现。